工人高某，在高尔夫球杆加工厂从事打磨工作8年，每天工作10小时以上，经常加班。最近几个月感觉手麻、手痛、手心出汗，持续性加重，抓握工具时感觉无力。经一般内、外科体检，未发现明显异常。明确诊断还需进行的检查是
A. 肌电图检查
B. 肌酸激酶测定
C. 风湿因子测定
D. X线片检查
E. 白指诱发试验

正确答案：E。白指诱发试验